关于恶性肿瘤特点的叙述中，下列说法不正确的是
A. 癌多见于老年，肉瘤多见于青壮年
B. 侵犯，破坏周围组织，界限不清，活动受限
C. 生长方式多为膨胀性生长
D. 对机体影响大，常迅速发展
E. 细胞形态和结构呈异型性，有异常核分裂

正确答案：C。生长方式多为膨胀性生长

解析：恶性肿瘤的生长方式为浸润性生长，膨胀性生长是良性肿瘤的特点。掌握“口腔颌面部肿瘤的概念、临床表现、诊断”知识点。